以下关于医疗卫生机构对医疗废物的管理说法错误的是
A. 《医疗废物管理条例》规定，医疗机构应当及时收集本单位产生的医疗废物，并按照类别分置于防渗漏、防锐器穿透的专用包装物或者密闭的容器内
B. 《医疗废物管理条例》规定，医疗废物暂时贮存的时间不得超过3天
C. 《医疗废物管理条例》规定，运送医疗废物的工具使用后应当在医疗卫生机构内指定的地点及时消毒和清洁
D. 《医疗废物管理条例》规定，医疗卫生机构应当根据就近集中处置的原则，及时将医疗废物集中处置单位处置
E. 《医疗废物管理条例》规定，医疗卫生机构产生的污水，应该按照国家规定严格消毒

正确答案：B。《医疗废物管理条例》规定，医疗废物暂时贮存的时间不得超过3天